适宜自己选药治疗的病证是
A. 坐车船眩晕
B. 中枢性眩晕
C. 前庭系统疾病所致的眩晕
D. 颈性眩晕
E. 药物中毒性眩晕

正确答案：A。坐车船眩晕